两经和两经以上病症同时出现的发病类型是
A. 合病
B. 并病
C. 感邪即发
D. 徐发
E. 继发

正确答案：A。合病

解析：合病为两经之病或两种疾病同时并见（A对）；并病，若一经病证未罢又出现另一部位病证者（B错）；感邪即发，又称为卒发、顿发，指机体感受病邪后，随即发病（C错）；徐发，徐缓而病的发病类型，多见于内伤邪气致病（D错）；继发，指在原发疾病未愈的基础上继而发生新的疾病（E错）。